医疗用毒性药品系指
A. 连续使用后易产生身体依赖性，能成瘾癖的药品
B. 毒性剧烈、治疗剂量与中毒剂量相近，使用不当会致人中毒或死亡的药品
C. 正常用法用量下出现与用药目的无关的或意外不良反应的药品
D. 直接作用中枢神经系统，毒性剧烈的药品
E. 毒性剧烈，连续使用后易产生较大毒副作用的药品

正确答案：B。毒性剧烈、治疗剂量与中毒剂量相近，使用不当会致人中毒或死亡的药品

解析：本题考查医疗用毒性药品。医疗用毒性药品（简称毒性药品），是指毒性剧烈，治疗剂量与中毒剂量相近，使用不当会致人中毒或死亡的药品（B对）。